腹股沟直疝最有诊断意义的临床表现是
A. 按压深环疝仍复出
B. 容易发生嵌顿
C. 疝囊颈位于腹壁下动脉外侧
D. 疝包块呈梨形
E. 最常见中年人

正确答案：A。按压深环疝仍复出

解析：腹股沟直疝最有诊断意义的临床表现是按压深环疝仍复出（A对）。容易发生嵌顿（B错）、疝囊颈位于腹壁下动脉外侧（C错）、疝包块呈梨形（D错）均为腹股沟斜疝的特点，中年人（E错）多发生斜疝，直疝多见于老年人。